静脉血经异常通道进入体循环动脉血中所致发绀常见于
A. 肺炎
B. 右心衰竭
C. 严重休克
D. 法洛四联症
E. 阻塞性肺气肿

正确答案：D。法洛四联症

解析：法洛四联症（P279）（D对）是联合的先天性心血管畸形，包括肺动脉狭窄、心室间隔缺损、主动脉骑跨和右心室肥大四大异常，是最常见的发绀型先天性心脏病。患者右心室血流（静脉血）可经骑跨的主动脉进入体循环动脉血中，使动脉血氧饱和度明显降低，而出现发绀现象。肺炎（A错）、右心衰竭（B错）、严重休克（C错）、阻塞性肺气肿（E错）均无心血管畸形，不会使静脉血经异常通道进入体循环动脉血。